关于深感觉传导通路描述，正确的是
A. 该传导通路只传导深感觉
B. 第二级神经元在脊髓后角
C. 在延髓下部形成内侧丘系交叉
D. 受损后将导致浅感觉障碍
E. 第三级纤维主要止于中央前回和中央旁小叶前部

正确答案：C。在延髓下部形成内侧丘系交叉

解析：躯干和四肢意识性本体感觉和精细触觉传导通路（A错）中，第1级神经元发出的纤维组成薄、楔束上行止于第2级神经元（位于延髓的薄、楔束核（B错）），第2级神经元发出纤维在延髓下部交叉至对侧形成内侧丘系交叉（C对），交叉后的纤维继续上行称内侧丘系，止于第3级神经元（丘脑腹后外侧核（E错））。深感觉传导通路传导的是深感觉，受损后将导致深感觉障碍（D错）。